患者突然昏倒扑地，神志不清，牙关紧闭，两目上视，手足抽搐，口吐涎沫，不久渐醒，醒后疲乏无力，舌苔白腻，脉滑。其治法是
A. 化痰息风，开窍定痫
B. 理气化痰，活血化瘀
C. 镇心祛痰，安神定痫
D. 清肝泻火，养血安神
E. 清肝泻火，化痰开窍

正确答案：A。化痰息风，开窍定痫

解析：题中患者突然昏仆，神志不清，手足抽搐，口吐涎沫等为痫病典型发作，加上舌苔脉象，为风痰闭阻证的表现，是痰浊素盛，肝阳化风，痰随风动，风痰闭阻，上干清窍所致，治宜涤痰息风，开窍定痫（A对）。